某医院发生一起医疗事故，医患双方在卫生行政部门的支持下就赔偿事宜达成和解的协议称为
A. 和解草案
B. 解决方案
C. 协议书
D. 调解书
E. 和解书

正确答案：D。调解书

解析：发生医疗事故等医疗损害赔偿争议，医患双方不愿意协商或者协商不成时，可以向卫生行政部门或者其他第三方如医疗纠纷人民调解委员会提出调解申请。经调解，医患双方就争议事实、赔偿数额达成协议的，制作调解书，当事人应当自觉履行。医患双方在卫生行政部门的支持下就赔偿事宜达成和解的协议称为调解书（D对）。协议书（C错）是没有第三方机构支持下，医患双方经协商达成一致意见而制作的（P334）。